属于C-苷类化合物
A. 黄芩苷
B. 葛根素
C. 二者均有此性质
D. 二者均无此性质

正确答案：B。葛根素

解析：本题考查的是黄酮苷的结构与分类。属于C-苷类化合物的是葛根素（B对）。除O-糖苷外，天然黄酮类化合物中还发现有C-键苷，如葛根素、葛根素木糖苷，为中药葛根中的扩张冠状动脉血管的有效成分。黄芩苷（A错）是通过酚羟基而成的苷，属于O-苷中的酚苷。